男性，5岁，持续发热15天，体温39.0～39.5℃，伴腹泻每日3～5次，体检：神萎，心率72次/分，肝右肋下2cm，脾肋下1.5cm，血常规检查：WBC3.0×10⁹/L，中性粒细胞60%，淋巴细胞40%，嗜酸粒细胞0.9，ALT200U/L，血清抗-HBs阳性，该病例最可能的诊断是
A. 急性乙型肝炎
B. 伤寒
C. 钩端螺旋体病
D. 急性血吸虫病
E. 急性细菌性痢疾

正确答案：B。伤寒

解析：5岁男性患儿（伤寒高发人群），持续发热15天，体温39.0～39.5℃，伴腹泻每日3～5次，查体可见神萎（伤寒面容），心率72次/分（相对缓脉），肝右肋下2cm，脾肋下1.5cm（肝脾肿大），血常规检查：WBC3.0×10⁹/L（成人正常参考值4～10×10⁹/L），中性粒细胞60%（成人正常参考值0.5～0.7），淋巴细胞40%（正常值0.2～0.4），嗜酸粒细胞0.9（成人正常参考值0.5%～5%），ALT200U/L（正常参考值0～40U/L），血清抗-HBs阳性（对HBV有免疫力），根据患儿的临床表现和实验室结果，该病例最可能的诊断是伤寒（B对），伤寒是由伤寒沙门菌引起的一种急性肠道传染病，临床特征为持续发热、表情淡漠、相对缓脉、玫瑰疹、肝脾大和白细胞减少等。急性乙型肝炎（A错）少有腹泻，ALT应显著升高，血清抗-HBs阳性表示对HBV有免疫力，见于乙型肝炎恢复期、既往感染及乙肝疫苗接种后，不能用于诊断肝炎，且急性乙肝现已少见（P28）。钩端螺旋体病（C错）病原体为致病性钩端螺旋体，主要临床特征早期为钩端螺旋体败血症，中期为各脏器损害和功能障碍，后期为各种变态性反应后并发症，重症患者有明显的肝、肾、中枢神经系统损害和弥漫性肺出血，常表现为发热、酸痛、全身软、眼红、腿痛、淋巴结肿大等（P253）。急性血吸虫病（D错）表现为发热、腹痛、腹泻或脓血便，有肝大及压痛，外周血象白细胞及嗜酸性粒细胞应增多（P297）。菌痢（E错）是以腹泻为主要表现的，且无肝脾肿大，血白细胞和中性粒细胞增高（P178）。